红霉素
A. 属繁殖期杀菌剂
B. 抗菌谱与青霉素相似但略广
C. 对革兰阳性菌有强大抗菌作用
D. 对青霉素耐药的金葡菌有效
E. 首选治疗军团菌

正确答案：B、C、D、E。抗菌谱与青霉素相似但略广；对革兰阳性菌有强大抗菌作用；对青霉素耐药的金葡菌有效；首选治疗军团菌